关于去甲肾上腺素的药理作用说法不正确的是
A. 去甲肾上腺素可以激动血管α1受体，收缩血管，增加冠脉流量
B. 去甲肾上腺素能够较弱的激动心脏β1受体，增加心排出量
C. 小剂量应用去甲肾上腺素时，可以使脉压增大
D. 大剂量应用去甲肾上腺素时，可以升高血糖
E. 小剂量可能引起心律失常

正确答案：E。小剂量可能引起心律失常

解析：本题考查去甲肾上腺素。去甲肾上腺素的药理作用如下：①去甲肾上腺素是冠脉舒张，增加冠脉流量（A对）；②去甲肾上腺素使心肌收缩力加强，心率加快，心排出量增大（B对）；但剂量过大时，可能引起心律失常（E错，为本题正确答案）；③小剂量应用去甲肾上腺素时，能够升高收缩压，而舒张压升高不明显，故脉压增大（C对）；④仅在大剂量应用去甲肾上腺素时才会出现血糖升高（D对）。